某县药品监督管理部门对辖区内一家医院监督检查时，发现该医院将本院配制的中药制剂上市销售，涉及货值金额5.7万元。该县药品监督管理部门认定不属于情节严重情形，除没收违法销售的制剂和违法所得外，对其处以一定金额的罚款。下列罚款符合《药品管理法》规定的是
A. 8.55万元
B. 22.8万元
C. 34.2万元
D. 50万元

正确答案：B。22.8万元

解析：本题考查法律责任。第一百三十三条违反本法规定，医疗机构将其配制的制剂在市场上销售的，责令改正，没收违法销售的制剂和违法所得，并处违法销售制剂货值金额二倍以上五倍以下的罚款；情节严重的，并处货值金额五倍以上十五倍以下的罚款；货值金额不足五万元的，按五万元计算。因涉及货值金额5.7万元，该县药品监督管理部门认定不属于情节严重情形，所以处违法销售制剂货值金额二倍以上五倍以下的罚款22.8万元（B对）。